《素问·五脏生成篇》说：“多食甘”，则
A. 肉胝皱而唇揭
B. 筋急而爪枯
C. 骨痛而发落
D. 脉凝泣而变色
E. 皮槁而毛拔

正确答案：C。骨痛而发落

解析：《素问·五藏生成》说：“是故多食咸，则脉凝泣而变色（D错）；多食苦，则皮槁而毛拔（E错）；多食辛，则筋急而爪枯（B错）；多食酸，则肉胝皱而唇揭（A错）；多食甘，则骨痛而发落（C对）”。